研制强化食品的目的不包括
A. 使某种食品达到特定目的的营养需要
B. 弥补某些食品天然营养素的缺陷
C. 为特定人群提供其所需要的营养素
D. 防止食品腐败变质
E. 添加食品加工过程中损失的营养素

正确答案：D。防止食品腐败变质